肝胃蕴热的口味是
A. 口中泛酸
B. 口中酸馊
C. 口甜粘腻
D. 口中味苦
E. 口中味咸

正确答案：A。口中泛酸

解析：酸味入肝，肝郁化热犯胃，胃失和降，则泛吐酸水（A对）。进食过量，食滞胃脘，化腐生酸，浊气上泛，则口中泛酸，气味酸腐（B错）。口甜而黏腻不爽多因湿热蕴结于脾，与谷气相搏，上蒸于口（C错）。心烦失眠者，常有口苦，乃心火上炎之故；胆汁味苦，故胆火上炎或胆气上泛，皆可致口苦（D错）。口咸是肾病及寒水上泛之故（E错）。